增加药物与TMPS酶结合，使抗癌效果增强的是
A. 磺胺类药+甲氧苄啶
B. 棒酸+阿莫西林
C. 依那普利+利尿药
D. 亚胺培南+西拉司丁
E. 氟尿嘧啶+醛氢叶酸

正确答案：E。氟尿嘧啶+醛氢叶酸

解析：本题考查药物的联合应用。增加药物与TMPS酶结合，使抗癌效果增强的是氟尿嘧啶+醛氢叶酸（E对）。磺胺类药+甲氧苄啶（A错）对细菌叶酸代谢呈双重阻断。棒酸+阿莫西林（B错）抑制β-内酰胺酶，对耐药菌株有效。依那普利+利尿药（C错）既增加降压效果，又减少不良反应。